雄黄的主要成分是
A. HgS
B. As₂S₂
C. Fe₂O₃
D. FeS₂
E. CaSO₄·2H₂O

正确答案：B。As₂S₂

解析：本题考查的是雄黄的来源。雄黄的主要成分是As₂S₂（B对）。雄黄：【来源】为硫化物类矿物雄黄族雄黄。主含二硫化二砷（As₂S₂）。HgS（A错）为朱砂的主要成分。朱砂：【来源】为硫化物类矿物辰砂族辰砂。主含硫化汞（HgS）。Fe₂O₃（C错）为赭石的主要成分。赭石：【来源】为氧化物类矿物刚玉族赤铁矿。主含三氧化二铁（Fe₂O₃）。FeS₂（D错）为自然铜的主要成分。自然铜：【来源】为硫化物类矿物黄铁矿族黄铁矿。主含二硫化铁（FeS₂）。CaSO₄·2H₂O（E错）为石膏主要成分。石膏：主含含水硫酸钙（CaSO₄·2H₂O）。